牙槽突骨折的特征性表现是
A. 伴牙缺失
B. 伴有唇和牙龈的肿胀和撕裂，撕裂口与牙相对应
C. 咬合错乱
D. 摇动损伤区某一牙时，邻近牙及骨折片随之移动
E. 伴牙折或牙脱位

正确答案：D。摇动损伤区某一牙时，邻近牙及骨折片随之移动

解析：本题考查牙槽突骨折最具特征的临床表现。牙槽突骨折最具特征的临床表现是摇动损伤区某一牙时，邻近牙及骨折片随之移动（D对）。临床上牙槽突骨折常伴有唇和牙龈的撕裂、肿胀、牙松动、牙折或牙脱落。当摇动损伤区的牙时，可见邻近数牙及骨折片随之移动，骨折片可移位而引起咬合错乱，这一点由牙槽突的解剖位置所决定。牙槽突是指上下颌骨容纳牙齿的部分，若颌骨的其他部分骨折则不会有“摇动损伤区的牙时，可见邻近数牙及骨折片随之移动”的表现，如下颌骨升支骨折，因为此区没有牙齿。